天然植物来源的抗心律失常药是
A. 盐酸普鲁卡因胺
B. 奎尼丁
C. 多非利特
D. 盐酸普罗帕酮
E. 胺碘酮

正确答案：B。奎尼丁

解析：本题考查奎尼丁。奎尼丁（B对）是从金鸡纳树皮中提炼出来的生物碱，为天然来源的抗心律失常药。盐酸普鲁卡因胺（A错）、多非利特（C错）、盐酸普罗帕酮（D错）、胺碘酮（E错）均不是天然植物来源。